对乳腺癌治疗方案设计和预后判断最有意义的是，检测前哨淋巴结
A. 大小
B. 是否有癌转移
C. 质地
D. 数量
E. 染色的状况

正确答案：B。是否有癌转移

解析：前哨淋巴结是指接受乳腺癌病灶引流的第一枚（站）淋巴结。该淋巴结有转移时表明腋淋巴结已有癌转移，预后欠佳，手术时需进一步作腋淋巴结清扫；该淋巴结阴性时，那么其他淋巴结有转移的可能性＜3%，预后较好，可不必施行淋巴结清扫术（七版黄家驷外科学P1160）。因此，对乳腺癌治疗方案设计和预后判断最有意义的是检测前哨淋巴结是否有癌转移（B对）。